起效慢，不能立即奏效，须连续应用2日才能出现平喘作用的药品是
A. 布地奈德
B. 扎鲁司特
C. 沙丁胺醇
D. 羧甲司坦
E. 多索茶碱

正确答案：A。布地奈德

解析：本题考查布地奈德。起效慢，不能立即奏效，须连续应用2日才能出现平喘作用的药品是布地奈德（A对）。布地奈德为吸入型糖皮质激素，为控制呼吸道炎症的预防性用药，起效缓慢，须连续规律的应用2日以上见效。扎鲁司特（B错）为白三烯受体拮抗剂，起效慢，一般连续应用4周起效。沙丁胺醇（C错）属于短效β₂受体激动剂，起效较快，可迅速缓解症状。羧甲司坦（D错）为祛痰药。